行口内注射行下牙槽神经阻滞麻醉后，针尖退至肌层、黏膜下时注射麻醉药可同时麻醉
A. 颊神经
B. 咬肌神经
C. 下颌神经
D. 鼻腭神经
E. 腭前神经

正确答案：A。颊神经

解析：由于行下牙槽神经麻醉的针刺点在翼下颌韧带中点外侧2～3mm处，此进针点周围正是颊神经分布的区域并接近颊神经干，所以可在下牙槽神经阻滞麻醉过程中，针尖退至肌层、黏膜下时注射麻醉药0.5～1ml，即能麻醉颊神经。掌握“颌面部常用局麻法及牙拔除的麻醉选择”知识点。